比沙可啶片的适宜服药时间是
A. 清晨
B. 餐前
C. 餐中
D. 餐后
E. 睡前

正确答案：E。睡前

解析：本题考查药品服用的适宜时间。比沙可啶是刺激性泻药，睡前（E对）服用后12h排便，于次日晨起泻下。适宜清晨（A错）服用的药物有抗高血压药物、抗抑郁药、利尿药、泻药等。适宜餐前（B错）服用的药物有胃黏膜保护剂、收敛药、促胃动力药、广谱抗线虫药。适宜餐中（C错）服用的药物有助消化药、非甾体抗炎药、肝胆辅助用药、减肥药、抗结核药。适宜餐后（D错）服用的药物有非甾体抗炎药、维生素、组胺H₂受体阻断剂。